男，59岁，近一个月来出现低热、胸痛、咳嗽、咯痰、有时痰中混有血丝。体格检查：消瘦，左锁骨上可触及一团质硬固定肿大淋巴结。胸部X线平片及胸部CT显示左上肺叶不张。最可能的临床诊断是
A. 肺结核
B. 肺炎
C. 肺脓肿
D. 支气管扩张
E. 支气管肺癌

正确答案：E。支气管肺癌

解析：老年男性患者，消瘦，低热、胸痛、咳嗽、咯痰、偶有痰中带血丝（提示可能有肺癌），左锁骨上可触及肿大淋巴结（提示可能有肿瘤淋巴结转移），胸部X线平片及CT示左上肺叶不张（提示支气管管腔被阻塞），结合患者病史、临床表现和影像学检查，该患者最可能的诊断为支气管肺癌（E对）。肺结核（A错）患者多有低热、盗汗等结核中毒症状，一般不会出现肿大淋巴结，胸片可有结核空洞征象但一般不会出现肺叶不张。肺炎（B错）主要表现为咳嗽、咳痰、发热，X线多表现为肺叶或肺段的实变阴影，一般无淋巴结肿大。肺脓肿（C错）常表现为高热，咳嗽、咳大量臭脓痰，早期X线表现为大片浓密模糊的浸润阴影，晚期可见液平及不规则增厚脓腔壁。支气管扩张（D错）主要表现为慢性咳嗽、大量脓痰和咯血，高分辨率CT可确诊。